与牙弓的（牙合）平面大致平行，是维持牙直立的主要力量的是
A. 牙槽嵴组
B. 水平组
C. 斜行组
D. 根间组
E. 根尖组

正确答案：B。水平组

解析：水平组：在牙槽嵴纤维的根方，呈水平方向分布，与牙弓的（牙合）平面大致平行。一端埋入牙骨质，另一端埋入牙槽骨中，是维持牙直立的主要力量，并与牙槽嵴纤维共同对抗侧方力，防止牙齿侧方移动。掌握“牙周膜”知识点。